患者在患病后变得以自我为中心、兴趣减少、依赖性增强，并过分关注自己的机体功能，这种心理反应属于
A. 猜疑加重
B. 行为退化
C. 感情淡漠
D. 焦虑增强
E. 情绪低落

正确答案：B。行为退化

解析：该患者病后以自我为中心、兴趣减少、依赖性增强，并过分关注自己的机体功能，属于行为退化的表现（B对）。猜疑加重属于妄想，不符合该病患的表现（A错），感情淡漠的患者表现为面部表情呆板，对周围发生的事物漠不关心，即使对与自身有密切利害关系的事情也如此（C错），无顾虑重重、紧张恐惧、坐立不安的表现（D错）。情绪低落表现为忧愁、苦闷、唉声叹气、暗自落泪等，有时感到前途灰暗，没有希望，严重时可因悲观绝望而出现自杀企图及行为（E错）。